女，68岁。突发上腹阵发性绞痛2小时，短时间内寒战高热，小便呈浓茶样，随后嗜睡。查体：T39.6℃，P128次/分，R30次/分，BP80/50mmHg。神志不清，躁动，巩膜黄染，右上腹肌紧张，有压痛和反跳痛。急症手术最有效的手术方式是
A. 胆总管切开减压术
B. 腹腔镜胆囊切除术
C. 胆囊造瘘术
D. 胆总管空肠吻合术
E. 胆总管十二指肠吻合术

正确答案：A。胆总管切开减压术

解析：老年女性患者，上腹绞痛，寒战高热，巩膜黄染（黄疸），血压80/50mmHg（休克），神志不清、躁动（中枢神经系统抑制现象），为典型的Reynolds五联征，应诊断为急性梗阻性化脓性胆管炎（AOSC）。AOSC的治疗原则是立即解除胆道梗阻，其中最有效的手术方式是胆总管切开减压（A对）术，可解除梗阻，阻止胆汁和细菌向血液的逆流，阻断病情恶化。腹腔镜胆囊切除术（B错）对解除胆管梗阻作用不大，主要用于急性胆囊炎的治疗。胆囊造瘘术（C错）难以达到有效的胆道引流，临床已经少有使用。胆总管空肠吻合术（D错）、胆总管十二指肠吻合术（E错）均为胆肠吻合术，对Oddi括约肌有损伤，术后易导致逆行感染，效果有限。